乳牙根管治疗术与恒牙根管治疗术最根本的区别是
A. 洞型制备不同
B. 消毒药物不同
C. 垫底材料不同
D. 根充材料不同
E. 充填材料不同

正确答案：D。根充材料不同

解析：本题考查乳牙牙髓病及根尖周病诊断及治疗。乳牙根管治疗术与恒牙根管治疗术最根本的区别是根充材料不同（D对）。乳牙应该采用可吸收的，不影响乳牙替换的根管充填材料，常用材料有氧化锌丁香油糊剂、碘仿糊剂、氧化锌碘仿糊剂、氢氧化钙糊剂等。